孕34周，血压160/110mmHg，尿蛋白5g/24h，上腹痛，头晕眼花。应诊断为
A. 妊娠高血压病
B. 重度子痫前期
C. 中度妊高征
D. 妊娠合并肝炎
E. 妊娠合并慢性肾炎

正确答案：B。重度子痫前期